将灭菌过程中不同受热温度与时间折算至与121热压灭菌效力相当的时间的参数是
A. F₀值
B. F值
C. Z值
D. D值
E. T值

正确答案：B。F值

解析：本题考查灭菌工艺有关参数。将灭菌过程中不同受热温度与时间折算至与121热压灭菌效力相当的时间的参数是F值（B对）。F值：F值为在一系列温度T下给定Z值所产生的灭菌效力与在参比温度T₀下给定Z值所产生的灭菌效力相同时，T₀温度下所相当的灭菌时间，以分为单位。即整个灭菌过程的效果相当于T₀温度下F时间的灭菌效果。F₀值（A错）：也可认为是相当于121℃热压灭菌时杀死容器中全部微生物所需要的时间。Z值（C错）：Z值为，在一定温度条件下对特定的微生物灭菌时，降低一个lgD值所需升高的温度数。D值（D错）：D的物理意义为，在一定温度下杀灭微生物90%或残存率为10%时所需的灭菌时间（分）。T（E错）—每个时间间隔Δt所测得被灭菌物温度。